男，25岁。反复腹痛、腹泻、便血10个月。近日加重伴发热，体温39℃，1天前因腹痛肌注阿托品治疗6小时后腹胀明显。查体：BP70/50mmHg，心率120次/分。最可能出现的情况是
A. 肠套叠
B. 肠穿孔
C. 肠梗阻
D. 肠出血
E. 中毒性巨结肠

正确答案：E。中毒性巨结肠

解析：青年患者表现出慢性腹痛、腹泻、便血，可考虑溃疡性结肠炎，近期病情加重，肌注阿托品后明显腹胀，并且急剧恶化，为中毒性巨结肠表现（E对）。肠套叠（A错）多见于小儿患者，典型性表现为急性的腹痛、血便与腹部肿块。肠穿孔（B错）可继发于溃疡、套叠、梗阻等病症，多有原发病表现，后突发腹部剧烈疼痛，伴全腹肌紧张。肠梗阻（C错）由引起原因不同而表现各异，共同特征包括腹痛，排便改变，梗阻以上腹胀，但注射阿托品后不会出现急剧恶化的表现。肠出血（D错）也根据不同病因表现不同，可有慢性腹痛、腹泻、便血，可由于感染而急性发作，注射阿托品后不会出现急剧恶化的表现。